卵巢恶性生殖细胞肿瘤的治疗首选
A. 顺铂+博莱霉素+依托泊苷
B. 顺铂+拓扑替康
C. 卡铂+紫杉醇
D. 卡铂+吉西他滨
E. 顺铂+阿霉素

正确答案：A。顺铂+博莱霉素+依托泊苷

解析：卵巢恶性生殖细胞肿瘤患者建议行全面分期手术，除Ⅰ期无性细胞瘤和Ⅰ期、G1（高分化）的未成熟畸胎瘤外，其他均需化疗。其化疗方案有BEP和EP。BEP方案包括博来霉素（B）+依托泊苷（E）+顺铂（P）（A对）。EP方案包括依托泊苷（E）+顺铂（P）。